艾滋病患者最常见的机会性感染是
A. 脑弓形虫病
B. 口腔毛状白斑
C. 隐球菌脑膜炎
D. 卡氏肺孢子虫肺炎
E. 口腔和食管念珠菌病

正确答案：D。卡氏肺孢子虫肺炎